长期大量服用维生素A可出现
A. 颅内压上升
B. 肢端肥大
C. 乳腺肿大
D. 尿频和腹泻
E. 肝肾损害和骨骼硬化

正确答案：A。颅内压上升

解析：本题考查维生素的不良反应。长期大量服用维生素A可引起慢性中毒，出现颅内压增高（A对）、发热、夜尿增多、毛发干枯或脱落、皮肤干燥或瘙痒、体重减轻、四肢疼痛、贫血、眼球突出、剧烈头痛等现象。大量服用维生素E可引起视物模糊、乳腺肿大（C错）等。维生素C毒性较小，偶见腹泻、皮肤红亮、头痛、尿频（D错）等。长期大量使用可引起泌尿系统尿酸盐、半胱氨酸盐或草酸盐结石。长期大量服用维生素D可出现肾脏损害、低热、惊厥、骨硬化等症（E错）。成年人长期使用生长激素类药物可引起肢端肥大症（B错）。